有关栓剂的不正确表述是
A. 栓剂在常温下为固体
B. 最常用的是肛门栓和阴道栓
C. 直肠吸收比口服吸收的干扰因素多
D. 栓剂给药不如口服方便
E. 甘油栓和洗必泰栓均为局部作用的栓剂

正确答案：C。直肠吸收比口服吸收的干扰因素多